下列各项，不属肝主疏泄功能的是
A. 调畅气机
B. 调畅情志
C. 促进骨骼发育
D. 促进脾胃的运化
E. 促进血液运行

正确答案：C。促进骨骼发育

解析：肾藏精，精生髓，髓居骨中以养骨，骨骼赖之以生长发育，所以促进骨骼发育与肾有关（C错，为本题正确答案）。调畅气机（A对），调畅情志（B对），促进脾胃的运化（D对），促进血液的运行（E对）均为肝主疏泄的生理功能。